依托泊苷注射液的溶媒选择要求是
A. 氯化钠注射液稀释
B. 5%葡萄糖注射液稀释
C. 先用乳酸钠注射液溶解，再用氯化钠注射液或5%葡萄糖注射液进一步稀释
D. 先用氯化钠注射液溶解，再用5%葡萄糖注射液进一步稀释
E. 先用氯化钠溶液溶解，再用氯化钠注射液或5%葡萄糖注射液进一步稀释

正确答案：A。氯化钠注射液稀释

解析：本题考查溶媒的选择要求。依托泊苷注射液的溶媒选择要求是氯化钠注射液稀释（A对）。托泊苷注射液的用法与用量如下：静脉滴注：将本品需用量用0.9%氯化钠注射液稀释，浓度不超过0.25mg/ml，静脉滴注时间不少于30～60min。